某女性向药师咨询在备孕状态可以预防流感的措施，说法正确的是
A. 接种流感疫苗，最好在10月底前完成免疫接种
B. 首选口服奥司他韦75mg qd预防流感
C. 首选口服奥司他韦75mg bid预防流感
D. 接种流感疫苗，三价灭活疫苗优于四价灭活疫苗
E. 接种流感疫苗后，第二日即可产生具有保护水平的抗体

正确答案：A。接种流感疫苗，最好在10月底前完成免疫接种

解析：本题考查预防流感的措施。我国各地每年流感活动高峰的出现时间和持续时间不同，为保证受种者在流感高发季节前获得免疫保护，最好在10月底前完成免疫接种（A对）。流感疫苗是预防流感最有效的手段（BC错），可以显著降低接种者罹患流感和发生严重并发症的风险。我国批准上市的流感疫苗包括三价疫苗和四价疫苗。对可接种不同类型、不同厂家疫苗产品的人群，可自愿接种任一种流感疫苗，无优先推荐（D错）。通常接种流感疫苗2周后，可产生具有保护水平的抗体（E错），6～8个月后抗体滴度开始衰减。